下列哪项不属于鼓胀的病理因素
A. 寒凝
B. 气滞
C. 水湿
D. 血瘀
E. 水液

正确答案：A。寒凝

解析：鼓胀的形成虽有种种因素，但其基本病理变化总属肝、脾、肾受损，气滞、血瘀、水停腹中。病理因素不外乎气滞（B对）、血瘀（D对）、水湿（C对）、水液（E对）停聚不去，腹部日益胀大成臌。故喻嘉言曾概括为“胀病亦不外水裹、气结、血瘀。”气、血、水三者既各有侧重，又常相互为因，错杂同病。故（A错，为本题正确答案）。